患者，男，55岁。1年来每日黎明之前腹微痛，痛即泄泻，腹部和下肢畏寒，舌淡苍白，脉沉细。治疗除取主穴外，还应加
A. 胃俞、合谷
B. 肝俞、内关
C. 三焦俞、公孙
D. 命门、关元
E. 关元俞、三阴交

正确答案：D。命门、关元

解析：由该患者的症状可知本病为泄泻之肾虚泄泻，故治疗上要配肾俞穴、命门、关元等补肾虚的腧穴，灸命门、关元为益命火，壮肾阳，以奏温养脾肾，腐熟水谷之功（D对）。胃俞穴可以治疗胃脘痛、呕吐、腹胀、肠鸣等胃病，合谷穴可以治疗头痛、目赤肿痛、齿痛、鼻衄、口眼歪斜、耳聋等头面五官诸疾；发热恶寒等外感病症，热病无汗或多汗；经闭、滞产等妇产科病症（A错）。肝俞穴可以治疗胁痛、黄疸等肝胆病症；目赤、目视不明、夜盲、迎风流泪等目疾；癫狂痫；脊背痛，内关穴可以治疗心痛、胸闷、心动过速或心动过缓等心疾；胃痛、呕吐、呃逆等胃腑病证；中风；失眠、郁证、癫狂痫等神志病证；眩晕症，如晕车、晕船、耳源性眩晕；肘臂挛痛（B错）。三焦俞可以治疗肠鸣、腹胀、呕吐、腹泻、痢疾等脾胃肠腑病症；小便不利、水肿等三焦气化不利病症；腰背强痛，公孙穴可以治疗胃痛、呕吐、腹痛、腹泻、痢疾等脾胃肠腑病证；心烦失眠，狂证等神志病证；逆气里急、气上冲心等冲脉病证（C错）。关元俞可以治疗腹胀、腹泻、腰骶痛、小便频数或不利，遗尿，三阴交穴可以治疗肠鸣腹胀、腹泻等脾胃虚弱诸证；月经不调、带下、阴挺、不孕、滞产等妇产科病症；遗精、阳痿、遗尿等生殖泌尿系统；心悸，失眠，高血压；下肢痿痹；阴虚诸证（E错）。